男性，56岁，间断性肉眼血尿1月余，镜下有血凝块,无腹痛、发热，无尿频、尿急、尿痛，B超示膀胱新生物，如果B超提示膀胱侧壁有一2cm新生物，乳头状，有蒂。最具价值的检查是
A. CT
B. MRI
C. 膀胱镜加活检
D. 膀胱造影
E. 腹部超声

正确答案：C。膀胱镜加活检

解析：中年男性患者，间歇性无痛性肉眼血尿（提示可能有泌尿系肿瘤），B超见膀胱内有一带蒂的新生物（提示膀胱肿瘤），结合患者临床表现和超声检查，应考虑为膀胱癌。诊断膀胱肿瘤最可靠的方法是膀胱镜检查+活检（C对），准确率接近100%。CT（A错）和MRI（B错）可用于显示肿瘤浸润膀胱壁深度、淋巴及内脏转移的情况，但不能确诊膀胱癌。膀胱造影（D错）显示充盈缺损提示膀胱肿瘤的可能，但可靠性不及膀胱镜活检。膀胱超声（E错）简便易行，能发现直径0.5cm以上的肿瘤，多用于病人的初筛检查。